根据临床相关不良反应报告，可能引起全身皮疹伴瘙痒、严重荨麻疹、间质性肾炎、白细胞减少、溶血性贫血、过敏性休克等不良反应的中成药是
A. 复方罗布麻颗粒
B. 仙灵骨葆胶囊
C. 珍菊降压片
D. 维C银翘片
E. 雷公藤多苷片

正确答案：D。维C银翘片

解析：本题考查的是中成药的不良反应。根据临床相关不良反应报告，可能引起全身皮疹伴瘙痒、严重荨麻疹、间质性肾炎、白细胞减少、溶血性贫血、过敏性休克等不良反应的中成药是维C银翘片（D对）。维C银翘片的不良反应表现：皮肤及附属器损害，表现为全身皮疹伴瘙痒、严重荨麻疹、重症多形红斑型药疹、大疱性表皮松解症；消化系统损害，表现为肝功能异常；全身性损害，表现为过敏性休克、过敏样反应、昏厥；泌尿系统损害，表现为间质性肾炎；血液系统损害，表现为白细胞减少、溶血性贫血。仙灵骨葆胶囊（B错）的不良反应表现：主要包括胃肠系统损害（占55.6%）、皮肤及其附件损害（占23.2%）、中枢及外周神经系统损害（占5.5%）等，不良反应表现包括恶心、呕吐、皮疹、瘙痒、腹痛、腹泻、腹胀、心悸、胸闷、肝功能异常、肝细胞损害等。在严重不良反应报告中，肝胆系统损害所占比例明显高于总体报告中的相应比例，不良反应表现包括肝酶水平升高、胆红素水平升高、肝细胞损害等。肝胆系统损害多见于中老年患者，其中45～64岁患者占40.5%，65岁以上患者占51.9%。大多数（约60.7%）肝损伤不良反应报告中的用药时间在30天以上。珍菊降压片（C错）的不良反应表现：消化系统表现为肝功能异常、黄疸、胰腺炎等；精神神经系统表现为头晕、视物模糊、运动障碍、麻木；皮肤及附件损害表现为剥脱性皮炎、全身水疱疹伴瘙痒等；代谢和营养障碍表现为低钾血症、低氯血症、低钠血症；有肾功能异常、心前区疼痛、心律失常、白细胞减少等个例报告。雷公藤多苷片（E错）属于雷公藤制剂。雷公藤制剂的不良反应表现：药物性肝炎、肾功能不全、粒细胞减少、白细胞减少、血小板减少、闭经、精子数量减少、心律失常等；严重者有肝肾功能异常、肾功能衰竭、胃出血等。